钩藤的功效是
A. 燥湿化痰
B. 祛风通络
C. 清热解毒
D. 燥湿祛痰
E. 清热平肝

正确答案：E。清热平肝

解析：本题考查的是钩藤的功效。钩藤的功效是清热平肝（E对）。钩藤：【功效】息风止痉，清热平肝。白附子：【功效】燥湿化痰（A错），祛风止痉，解毒散结。天麻：【功效】息风止痉，平抑肝阳，祛风通络（B错）。菊花：【功效】疏散风热，平肝明目，清热解毒（C错）。雄黄：【功效】解毒，杀虫，燥湿祛痰（D错），截疟定惊。